休克时组织细胞缺血缺氧必然导致
A. 高碳酸血症
B. 酸中毒
C. 酮体堆积
D. 呼吸性碱中毒
E. 代谢性碱中毒

正确答案：B。酸中毒

解析：休克时的微循环障碍及组织缺氧，使线粒体氧化磷酸化受抑，葡萄糖无氧酵解增强及乳酸生成增多。同时，由于肝功能受损不能将乳酸转化为葡萄糖，肾功能受损不能将乳酸排除，结果导致高乳酸血症及代谢性酸中毒（B对ACE错）。休克后期由于休克肺的发生，患者因通气、换气功能障碍，又可出现呼吸性酸中毒（D错），使机体处于混合性酸碱失衡状态。